脾主升清的确切内涵是
A. 脾的阳气主升
B. 脾气以升为健
C. 脾气散精，上归于肺
D. 与胃的降浊相对而言
E. 输布津液，防止水湿内生

正确答案：C。脾气散精，上归于肺

解析：“清”指水谷精微等营养物质。脾主升清指的是脾气的升动，将胃肠吸收的水谷精微和水液上输于心、肺等脏，通过心、肺的作用化生气血，以营养濡润全身，即脾气散精，上归于肺（C对）。